男性，60岁，颈后局限性肿痛6天，伴有畏寒、发热38.5℃，就诊时已用抗生素治疗3天，体格检查见颈后发际下方肿胀，皮肤红肿，质地坚韧，界限不清，其中央多个小脓头伴坏死组织，白细胞数16×109/L，中性粒细胞（0.9）。此时最恰当的治疗选择是
A. 继续抗生素静脉应用
B. 理疗
C. 做+形切口引流
D. 外敷中药膏
E. 免疫治疗

正确答案：C。做+形切口引流

解析：题中患者临床表现符合痈的特点，并且已经出现多个脓点，符合切开引流的指征。掌握“软组织急性感染”知识点。